“亚硝酸钠-硫代硫酸钠”疗法：立即将亚硝酸异戊酯1～2支包在手帕或纱布内弄碎，给患者吸入15～30秒，每隔3分钟重复1次。接着静脉缓慢注射3%亚硝酸钠10～15ml，随即用同一针头缓慢静脉注射硫代硫酸钠20～50ml。下列哪种离子经上述疗法转变为无毒的代谢物质
A. O²⁻
B. CN⁻
C. Fe²⁺
D. Fe³⁺
E. OH⁻

正确答案：B。CN⁻